口腔念珠菌病常发生于以下情况，除外
A. 长期使用广谱抗生素
B. 长期使用免疫抑制剂
C. 患有慢性消耗性疾病
D. 长期精神紧张
E. 白色念珠菌本身毒力增强

正确答案：D。长期精神紧张

解析：本题考查口腔念珠菌病的病因和发病机制。长期精神紧张（D错，为本题的正确答案）并不是念珠菌病的易感因素，其可诱发口腔复发性阿弗他溃疡等疾病。口腔念珠菌是条件致病菌，发生于白色念珠菌本身毒力增强（E对），宿主防御能力降低和有易感因素的时候。长期使用光谱抗生素（A对）会造成体内菌群失调，念珠菌趁机大量繁殖，使宿主发生念珠菌病。长期使用免疫抑制剂（B对）可以导致宿主免疫功能下降，抵御念珠菌的能力降低，使念珠菌致病。患有慢性消耗性疾病（C错）时机体能量过度消耗，机体总能量负平衡，内分泌紊乱，使念珠菌更易致病。